治疗经间期出血肾阴虚证，应首选
A. 两地汤
B. 逐瘀止血汤
C. 清肝止淋汤
D. 清热固经汤
E. 燥湿化痰汤

正确答案：A。两地汤

解析：肾阴偏虚，虚火内生，虚火与阳气相搏，损及阴络，冲任不固，发生经间期出血。治疗当滋肾养阴，固冲止血，两地汤的功效为滋阴壮水，为治疗经间期出血肾阴虚证的首选（A对）。逐瘀止血汤的功效为活血祛瘀，养阴止血，治疗血瘀证（B错）。清肝止淋汤的功效为清利湿热，固冲止血，治疗湿热证（C错）。清热固经汤的功效为清热凉血，固冲止血，治疗实热证（D错）。燥湿化痰汤燥湿理气化痰，和中利胆，治疗湿痰证（E错）。